十二经脉中，阴经与阴经的交接部位在
A. 胸部
B. 腹部
C. 胸腹部
D. 四肢内侧
E. 指(趾)内侧端

正确答案：A。胸部

解析：十二经脉循行交接规律是：①相表里的阴经与阳经在手足末端交接（DE错）。②同名的阳经与阳经在头面部交接。③相互衔接的阴经与阴经在胸中交接（A对）。足三阴经从足走腹胸，但与其他阴经不交与腹部（BC错）。记忆：可结合中基（P160）图4-1的十二经脉走向交接规律示意图记忆。